手术后进行皮瓣监测最常用的方法不包括
A. 观察皮瓣的颜色
B. 温度
C. 充盈状况
D. 体积
E. 针刺出血情况

正确答案：D。体积

解析：手术后进行皮瓣监测的目的是及早发现皮瓣灌注受损的征象，目前最常用的方法仍是临床观察，包括观察皮瓣的颜色、温度、充盈状况、针刺出血情况等。体积属于干扰项。掌握“皮片移植”知识点。